含有三苯乙烯结构，通过拮抗雌激素受体，用于乳腺癌治疗的药物是
A. 来曲唑
B. 枸橼酸他莫昔芬
C. 氟尿嘧啶
D. 氟他胺
E. 氟康唑

正确答案：B。枸橼酸他莫昔芬

解析：本题考查枸橼酸他莫昔芬的结构和药理作用。枸橼酸他莫昔芬（B对）含有三苯乙烯结构，为选择性雌激素受体拮抗剂，可用于乳腺癌治疗。